属于病因治疗的是
A. 阻止毒物继续进入人体内，促使毒物排泄以及拮抗或解除其毒作用
B. 缓解毒物引起的主要症状，以促进人体功能的恢复
C. 提高患者抗病能力，促使早日恢复健康
D. 降低车间空气中毒物浓度
E. 加强个人防护和个人卫生

正确答案：A。阻止毒物继续进入人体内，促使毒物排泄以及拮抗或解除其毒作用

解析：本题考查病因治疗的概念。职业中毒的治疗可分为病因治疗、对症治疗和支持疗法三类。病因治疗就是要阻止毒物继续进入人体内，促使毒物排泄以及拮抗或解除其毒作用（A对BCDE错），以达到尽可能消除或减少致病的物质基础，并针对毒物致病的机制进行处理的目的。